张力性气胸行闭式引流书，拔管最合适的时间是漏气停止
A. 可立即拔管
B. 24小时后拔管
C. 48小时后拔管
D. 72小时后拔管
E. 一周后拔管

正确答案：B。24小时后拔管

解析：最合适的时间是漏气停止24小时后，X线检查证实肺已膨胀方可拔管。掌握“气胸”知识点。